干燥过程中，可溶性成分在颗粒之间迁移时，片剂会出现
A. 含量不均匀
B. 硬度不够
C. 色斑
D. 裂片
E. 崩解迟缓

正确答案：A。含量不均匀

解析：本题考查片剂的干燥。在干燥前，水分均匀地分布于湿粒中，在干燥过程中，颗粒表面的水分发生气化，使颗粒内外形成了温度差，因而，颗粒内部的水分向外表面扩散时，这种水溶性成分也被转移到颗粒的外表面，这就是所谓的迁移过程。颗粒之间发生可溶性成分迁移，将大大影响片剂的含量均匀度（A对），尤其是采用箱式干燥时，底层颗粒中的可溶性成分迁移到上层颗粒之中使上层颗粒中的可溶性成分含量增大，使用这种颗粒压片时，必然造成片剂的含量不均匀。